关于糖皮质激素的应用，下列哪项错误
A. 水痘和带状疱疹
B. 风湿和类风湿性关节炎
C. 血小板减少症和再生障碍性贫血
D. 过敏性休克和心源性休克
E. 中毒性肺炎，重症伤寒和急性粟粒性肺结核

正确答案：A。水痘和带状疱疹